下列哪组属行针辅助手法
A. 提插法，捻转法，震颤法
B. 提插法，捻转法，弹针法
C. 震颤法，弹针法，刮柄法
D. 提插法，捻转法，刮柄法
E. 提插法，刮柄法，震颤法

正确答案：C。震颤法，弹针法，刮柄法

解析：该题考查行针手法。要注意区别行针手法的基本手法和辅助手法。毫针行针手法以提插、捻转为基本操作手法（ABDE错）。针刺操作时，为了取得较好的针感，除运用基本手法外，还有辅助手法，包括循、刮、弹、摇、震颤等（C对）。